消化道造影检查常用的造影剂是
A. 碘化油
B. 硫酸钡
C. 胆影葡胺
D. 泛影葡胺
E. 气体

正确答案：B。硫酸钡

解析：消化道造影检查常用的造影剂是硫酸钡（B对E错）。碘油造影是以碘化油为造影剂所进行的经X线的子宫输卵管造影（A错）。胆影葡胺静脉注射后，造影剂进入体内，胆管和胆囊内浓度较周围软组织高，从而形成密度对比而显影（C错）。泛影葡胺静脉注射后，绝大部分于较短时间内经肾滤过而随尿排出。对肾脏显影较好，常用于泌尿系统造影（D错）。